不参与构成臀部十字吻合的血管是
A. 臀下动脉
B. 旋髂深动脉
C. 臀上动脉
D. 旋股内侧动脉
E. 旋股外侧动脉

正确答案：B。旋髂深动脉

解析：臀下动脉（A对）、臀上动脉（C对）、旋股内侧动脉（D对）、旋股外侧动脉（E对）均为参与构成臀部十字吻合的血管。旋髂深动脉（B错，为本题正确答案）分支营养髂嵴及邻近肌，不参与构成臀部十字吻合。